肛瘘手术治疗的关键在于
A. 内口位置
B. 外口位置
C. 外口到肛门距离
D. 是否感染
E. 瘘管大小

正确答案：A。内口位置

解析：肛瘘手术治疗的关键在于明确瘘管行程和内口位置（A对），尽量减少肛门括约肌的损伤，防止肛门失禁，同时避免瘘的复发。